“血府”指的是
A. 脑
B. 髓
C. 骨
D. 脉
E. 女子胞

正确答案：D。脉

解析：因为血脉，是血液运行的通道，所以脉为“血之府”（D对）。脑（A错）为脑髓汇聚而成，又名“髓海”。诸髓（B错）者，皆属于脑。骨（C错）为肾之余。女子胞（E错）又称胞宫，子宫，子脏。